封失活剂应注意
A. 暂封窝洞时勿推动失活剂
B. 失活剂置于穿髓孔
C. 位于牙龈下的窝洞可采用分层封药法
D. 近牙龈处的窝洞封药前应注意窝洞环境的干燥
E. 以上都应注意

正确答案：E。以上都应注意

解析：本题考查封失活剂的注意事项。失活剂是用化学药物制剂封于牙髓创面上，使牙髓组织坏死失去活力的方法。封失活剂应注意：封粘固剂时，要注意不能推动失活剂（A对），如果将其移位离开穿髓孔，则不能达到失活效果，因此放置失活剂时，应将其置于穿髓孔处（B对）。位于牙龈下的窝洞视野模糊，一次性封药可能会使失活剂移位并接触牙龈，会损伤牙龈甚至牙槽骨，造成不良后果，因此位于牙龈下的窝洞可采用分层封药法（C对）。近牙龈处的龈沟液比较多，窝洞易被污染，使失活剂失效，因此应在近牙龈处的窝洞封药前应注意窝洞环境的干燥（D对），放置失活剂于穿髓孔处并使其紧贴暴露的牙髓组织以免唾液和龈沟液污染干燥的窝洞环境。综上，以上都应注意（E对，为本题正确答案）。